不符合单纯性肾病的临床表现是
A. 全身浮肿
B. 大量蛋白尿
C. 低白蛋白血症
D. 肉眼血尿
E. 高胆固醇血症

正确答案：D。肉眼血尿

解析：单纯性肾病，又称单纯性肾病综合症，一种小儿常见的疾病，它主要症状表现就是水肿，具备四大特征：①全身不同程度水肿（A对）②大量蛋白尿（B对）③低蛋白血症（C对）④高胆固醇血症（E对）。其中以大量蛋白尿和低蛋白血症为必备条件。肉眼血尿（D错，为本题正确答案）不符合单纯性肾病的临床表现。